男，63岁，乏力、腹胀3个月，加重伴尿少1个月。慢性肝炎病史20余年。查体：巩膜轻度黄染，肝肋下4cm，质硬，脾肋下3cm，移动性浊音阳性，双下肢水肿。对诊断最有意义的实验室检查是
A. 腹水铁蛋白
B. 血癌胚抗原
C. 血甲胎蛋白
D. 血CA125
E. 腹水腺苷脱氨酶

正确答案：C。血甲胎蛋白

解析：老年患者，长期肝炎病史，近期肝肿大质硬，出现巩膜轻度黄染（黄疸）、移动性浊音阳性（腹水），应高度怀疑原发性肝癌。血甲胎蛋白（C对）是原发性肝癌肿瘤标志物，对诊断最有意义。腹水铁蛋白（A错）、腹水腺苷脱氨酶（E错）主要用于鉴别良、恶性腹水，而对于确诊肝癌意义不大。血癌胚抗原（B错）是一种广谱性肿瘤标志物，可在多种肿瘤中表达，脏器特异性低；血CA125（D错）主要用于卵巢癌的诊断，肝硬化失代偿期血清CA125也有升高，二者对于肝癌诊断价值不大。